龋发病一系列过程中最重要、最具实际意义的步骤
A. 牙菌斑形成
B. 分解代谢
C. 硬组织脱矿
D. 合成代谢
E. 菌斑溶解

正确答案：C。硬组织脱矿

解析：牙菌斑内糖代谢，细菌利用底物产酸，酸使牙齿脱矿，这是龋发病一系列过程中最重要、最具实际意义的步骤。掌握“龋病的临床表现与分类”知识点。